心尖部触及收缩期震颤提示
A. 二尖瓣狭窄
B. 室间隔穿孔
C. 室壁瘤形成
D. 主动脉瓣关闭不全
E. 二尖瓣脱垂

正确答案：E。二尖瓣脱垂

解析：二尖瓣脱垂（E对）是指乳头肌上的二尖瓣叶（多为后叶，双叶次之，前叶少见）在心室收缩晚期脱垂到左心房而形成二尖瓣关闭不全。二尖瓣关闭不全的典型杂音为心尖区全收缩期吹风样杂音，并可伴有收缩期震颤。二尖瓣狭窄（A错）的典型体征是心尖部舒张中晚期隆隆样杂音。室间隔穿孔（B错）的典型体征是胸骨左缘第3、4肋间收缩期杂音。室壁瘤（C错）患者超声心动图或放射性核素心室造影可发现左室节段性收缩期反常膨出。进行心脏触诊时可以感觉到到双重搏动。一般不会出现心尖部收缩期的杂音。主动脉瓣关闭不全（D错）的典型体征是胸骨左缘第3肋间舒张期叹气样杂音。